男，25岁，发现血尿、蛋白尿2年。查体：BP150/90mmHg，双下肢无水肿。实验室检查：尿蛋白定量0.5～0.8g/d，尿RBC5～10/HP，血Cr125μmol/L，血胆固醇6.0mmol/L。B超表示双肾大小正常。首选的进一步检查项目是
A. 肾穿刺病理检查
B. 双肾CT
C. 肾小管功能检查
D. 肾动脉造影
E. 24小时尿钠测定

正确答案：A。肾穿刺病理检查

解析：青年男性患者，发现血尿、蛋白尿2年（＞3个月，提示有慢性肾脏病）。查体：BP150/90mmHg（正常为90～130/60～90mmHg，提示有高血压）。实验室检查：尿蛋白定量0.5～0.8g/d（正常≤0.15g/d，提示有蛋白尿），尿RBC5～10/HP（正常值0～3个/HP，提示有血尿），血胆固醇6.0mmol/L（正常值2.4～5.5mmol/L，提示有高胆固醇血症），血尿、蛋白尿、高血压为肾炎综合征的基础表现。B超显示双肾大小正常。综合患者的病史、临床表现、实验室检查，考虑诊断为慢性肾小球肾炎，首选的进一步检查项目是肾穿刺病理检查（A对）。肾穿刺病理检查可以直接观察肾脏形态改变，并能明确肾小球疾病的病因、病理类型、发展趋势等。双肾CT（B错）为影像学检查，仅能观察肾脏的形态，不能明确诊断病因。肾动脉造影（D错）主要用于肾动脉狭窄性高血压的诊断。肾小管功能检查（C错）、24小时尿钠测定（八版诊断学P317）（E错）均是用来反应肾小管功能状态的检查。